对NK细胞描述错误的是
A. 活化后表达Fas
B. 可直接杀伤某些肿瘤细胞
C. 可间接杀伤某些病毒感染细胞
D. 分泌TNF-α
E. 具有免疫调节作用

正确答案：A。活化后表达Fas